C级）。根据CTP评分结果，药师的用药建议是
A. 该患者重度肝功能不全，不建议使用伏立康唑
B. 该患者轻度肝功能不全，伏立康唑维持剂量不变
C. 该患者轻度肝功能不全，伏立康唑维持量减少25%
D. 该患者中度肝功能不全，伏立康唑维持剂量减少50%
E. 该患者中度肝功能不全，伏立康唑维持剂量减少75%

正确答案：A。该患者重度肝功能不全，不建议使用伏立康唑

解析：本题考查CTP的评分标准。根据（CTP）评分标准：该患者13分（CTP C级），为重度肝功能不全，不建议使用伏立康唑（A对）。CTP的评价计分标准为总分5～6分为CTP A级或轻度肝功能不全，7～9分为CTP B级或中度肝功能不全，10～15分为CTP C级或重度肝功能不全。重度肝功能不全患者不建议使用伏立康唑、西地那非、毛果芸香碱等药物。